革兰阳性细菌不具备的成分是
A. 肽聚糖
B. 脂多糖
C. 磷壁酸
D. N-乙酰胞壁酸
E. N-乙酰葡糖胺

正确答案：B。脂多糖